支配提睾肌的神经是
A. 髂腹下神经
B. 髂腹股沟神经
C. 闭孔神经
D. 生殖股神经
E. 无

正确答案：D。生殖股神经

解析：髂腹下神经（A错）分布于腹壁诸肌。髂腹股沟神经（B错）分布于附近的腹壁肌。闭孔神经（C错）主要支配闭孔外肌、长收肌、短收肌、大收肌和股薄肌，偶见发出分支至耻骨肌。生殖股神经（D对）分布于提睾肌和阴囊。